适用于熔融法制备固体分散物的载体材料是
A. 明胶
B. 聚酰胺
C. 脂质类
D. 聚维酮
E. β-CD

正确答案：C。脂质类